纳洛酮用于治疗的疾病或症状是
A. 剧烈疼痛
B. 失眠
C. 惊厥
D. 抑郁症
E. 阿片类中毒

正确答案：E。阿片类中毒

解析：本题考查纳洛酮。纳洛酮为阿片受体阻断剂，可用于阿片类中毒的解救（E对），解救可静脉注射纳洛酮0.005～0.01mg/kg，成人0.4mg；剧烈疼痛（A错）可用阿片受体激动药如哌替啶；失眠（B错）一般用镇静催眠药如地西泮；惊厥（C错）可用抗惊厥药硫酸镁、巴比妥类药物；常用的抗抑郁药（D错）主要有氟西汀、帕罗西汀、舍曲林、西酞普兰等。